多发生在常态角色向患者角色转化时，或发生在疾病突然加重时的是
A. 角色行为冲突
B. 角色行为缺如
C. 角色行为适应
D. 角色行为减退
E. 角色行为强化

正确答案：B。角色行为缺如

解析：角色行为缺如：多发生在常态角色向患者角色转化时，或发生在疾病突然加重时。表现为患者意识不到自己有病，或否认病情的严重程度，其原因是患者的社会角色或状态不能接患者角色而表现出否认心理。这类人常因疾病会影响学习、工作、婚姻、事业等，而不愿承担患者角色；这种行为的后果往往是疾病因治疗被延误而加重。所以医务人员对这类患者要多介绍一些有关的医学知识，使其正视疾病，尽快进入患者角色。掌握“患者角色和求医行为”知识点。